病毒、朊粒属于
A. 非细胞型微生物
B. 真核细胞型微生物
C. 原核细胞型微生物
D. 支原体
E. 细菌

正确答案：A。非细胞型微生物

解析：非细胞型微生物为形体最小，包括病毒、朊粒等。掌握“微生物定义、分类及特点”知识点。